《中国药典》规定，应测定相对密度的药材是
A. 血竭
B. 儿茶
C. 蟾酥
D. 蜂蜜
E. 冰片

正确答案：D。蜂蜜

解析：本题考查的是中药材物理常数的测定。《中国药典》规定，应测定相对密度的药材是蜂蜜（D对）。物理常数的测定：包括相对密度、旋光度、折光率、硬度、黏稠度、沸点、凝固点、熔点等的测定。这对挥发油、油脂类、树脂类、液体类药（如蜂蜜等）和加工品类（如阿胶等）药材的真实性和纯度的鉴定，具有特别重要的意义。药材中如掺有其他物质时，物理常数就会随之改变，如蜂蜜中掺水就会影响黏稠度，使比重降低。据报道，在蜂蜜中掺蔗糖，经旋光度检查，正品蜂蜜（含蔗糖量约为5%）为左旋，掺蔗糖的蜂蜜（庶糖含量超过20%）变为右旋。所以《中国药典》对有些药材的物理常数做了规定，如蜂蜜的相对密度（25℃）在1.349以上，薄荷油为0.888～0.908；冰片（E错）（合成龙脑）的熔点为205℃～210℃；肉桂油的折光率为1.602～1.614等。天竺黄规定检查体积比，即取天竺黄粉末（过4号筛）10g，轻轻装入量筒内，其体积不得少于35ml。这是一种类似测定相对密度的方法，实际上也可推广用于测定其他药材，特别是对经验鉴别习用“质轻”或“质重”术语时，就比较容易掌握轻重的标准。血竭（A错）粉末，置白纸上，用火隔纸烘烤即熔化，但无扩散的油迹，对光照视呈鲜艳的红色。以火燃烧则产生呛鼻的烟气。儿茶（B错）：取火柴杆浸于本品水浸液中，使轻微着色，待干燥后，再浸入盐酸中立即取出，置火焰附近烘烤，杆上即显深红色。蟾酥（C错）气微腥，味初甜而后有持久的麻辣感，粉末嗅之作嚏。